女，28岁。妊娠2个月，到某大学附属医院妇产科接受人工流产手术。接诊医师在给患者检查时，旁边有10多位男女见习医学生。患者要求见习医学生出去，被接诊医师拒绝，随后医师边操作边给医学生讲解。术后患者质问医师为何示教未事先告知，医师认为患者在医院无隐私，后患者以隐私权被侵犯为由，要求当地卫生行政部门进行处理。基于该案例，该患者就诊期间未被满足的心理需要为
A. 尊重的需要
B. 生理的需要
C. 归属与爱的需要
D. 自我实现的需要
E. 安全的需要

正确答案：A。尊重的需要

解析：女性患者，人工流产手术检查时，患者要求见习医学生出去，医师拒绝并边操作边给医学生讲解，患者未得到尊重，该患者就诊期间未被满足的心理需要为尊重的需要（A对）。马斯洛需求层次理论把人的需要分为五个层次：生理需要、安全需要、归属与爱的需要、尊重的需要、自我实现需要。生理的需要（B错）是个体生存必不可少的需要，具有自我和种族保存的意义。其中以饥饿和渴的需要为主。安全的需要（E错）包括对生命安全、财产安全、职业安全和心理安全的需要，以求免受威胁、免于孤独、免受别人的侵犯。归属和爱的需要（C错）是参加一定的组织，依附于某个团体等和接受他人和给予他人爱的需求。尊重的需要（A对）包括自我尊重和他人尊重两个方面。他人尊重包括希望受到他人的尊重。自我实现的需要（D错）指个体的潜能和天赋得到充分的发挥。